男，60岁，戴义齿2天，感上唇向下活动时疼痛，义齿摘戴困难。查：右上1234567左上12可摘局部义齿，左上37单臂卡环，卡环与基牙贴合，上前弓区基托伸展过长，摘戴义齿阻力较大。余之无异常。造成疼痛及摘戴义齿困难的原因可能是，除了
A. 卡环过紧
B. 基托紧贴牙面
C. 基托进入倒凹区
D. 义齿基托面积较大
E. 患者未掌握摘戴义齿的方法

正确答案：D。义齿基托面积较大

解析：本题考查造成疼痛及摘戴义齿困难的原因。此患者缺失牙较多，需要大量黏膜支持，所以义齿基托面积需要大些（D错，为本题的正确答案），但单纯的基托面积大不会引起疼痛和摘戴困难，只有缓冲不够时才会造成疼痛和摘戴困难。此患者查体见上前弓区基托伸展过长，因此上唇向下活动时疼痛，是因基托边缘过长进入倒凹区（C对）压迫唇侧黏膜所致。查体见卡环与基牙贴合，摘戴义齿阻力较大，因此摘戴义齿困难原因可能为卡环过紧（A对）。此外基托紧贴牙面（B对）、倒凹区基托缓冲不够、患者没有掌握义齿摘戴方向和方法（E对）也可能造成义齿摘戴困难。